线粒体内膜复合物Ⅴ的F1
A. 含有寡霉素敏感蛋白
B. 具有ATP合酶活性
C. 结合GDP后发生构象改变
D. 存在单加氧酶
E. 存在H⁺通道

正确答案：B。具有ATP合酶活性